临床脑死亡的首要指标
A. 自主心跳停止
B. 自主呼吸停止
C. 自主心跳、呼吸停止
D. 瞳孔对光反射消失
E. 不可逆昏迷

正确答案：B。自主呼吸停止

解析：由于心肌具有自发收缩特性，在脑干死亡后的一定时间内还可能有微弱的心跳，因此，自主呼吸停止（B对）被认为是临床脑死亡的首要指标。